何者错误
A. 关节面呈前宽后窄
B. 踝关节扭伤多发生在走上坡路时
C. 关节囊前、后方松弛
D. 内侧韧带又名三角韧带
E. 外侧韧带包括距腓前、后韧带和距腓韧带

正确答案：B。踝关节扭伤多发生在走上坡路时

解析：距小腿关节由胫、腓骨的下端与距骨滑车构成，距骨滑车前宽后窄（A对），关节面的周围，囊的前、后壁薄而松弛（C对），两侧有韧带增厚加强，关节囊内侧有内侧韧带（亦称三角韧带）（D对）。外侧韧带由距腓前、后韧带和距腓韧带组成（E对）。趾屈时，较窄的滑车后部进入关节窝内，关节不够稳定，故踝关节扭伤多发生在跖屈时，如下山、下坡（B错，为本题正确答案）、下楼梯的情况。